脊髓外侧索的上行传导束是
A. 皮质脊髓侧束
B. 脊髓丘脑侧束
C. 皮质脊髓前束
D. 脊髓丘脑前束
E. 无

正确答案：B。脊髓丘脑侧束

解析：脊髓丘脑侧束（B对）位于脊髓外侧索；皮质脊髓束起于大脑皮质中央前回和其他一些皮质区域，下行至延髓锥体交叉处,大部分纤维交叉至对侧，称为皮质脊髓侧束（A错），未交叉的纤维在同侧 下行为皮质脊髓前束（C错）；脊髓丘脑前束（D错位于前索，前根纤维的内侧，主要传递粗触觉、压觉信息。